男性，50岁。诉左下后牙长期咬合不适，进冷热饮食时有刺激痛。口腔检查：左下6深龋洞，温度刺激试验有迟缓痛，去尽腐质无肉眼可见露髓孔，探诊（+），叩诊（-），无松动，牙周检查（-）。拟诊为
A. 慢性根尖周脓肿
B. 根尖囊肿
C. 慢性溃疡性牙髓炎
D. 慢性闭锁性牙髓炎
E. 慢性增生性牙髓炎

正确答案：D。慢性闭锁性牙髓炎

解析：本题考查慢性闭锁性牙髓炎。男性，50岁。诉左下后牙长期咬合不适，进冷热饮食时有刺激痛。口腔检查：左下6深龋洞，温度刺激试验有迟缓痛，去尽腐质无肉眼可见露髓孔，探诊（+），叩诊（-），无松动，牙周检查（-）。拟诊为慢性闭锁性牙髓炎（D对）。根据题目中的信息左下6深龋洞，温度刺激试验有迟缓痛，去尽腐质无肉眼可见露髓孔，可诊断为慢性闭锁性牙髓炎。慢性根尖周脓肿和根尖周囊肿去净腐质可见穿髓孔（AB错）。慢性溃疡性牙髓炎食物嵌入患牙洞内即可出现剧烈的疼痛，且冷热刺激激惹牙髓引起剧烈疼痛（C错）。慢性增生性牙髓炎可见红色“蘑菇”形状的肉芽组织，即牙髓息肉（E错）。